男，25岁。右膝关节和左足跟肿痛4周。曾有下半夜腰痛病史4年。查体：右膝肿胀压痛，浮髌征阳性，左侧“4”字征阳性，左侧骶髂关节压痛，左侧足跟肿胀压痛。对诊断最有价值的检查是
A. 类风湿因子
B. 骶髂关节X线片
C. 抗CCP抗体
D. 右膝关节X片
E. HLA-B27

正确答案：B。骶髂关节X线片

解析：25岁男性（强制性脊柱炎好发于20～30岁男性），下半夜腰痛4年（强制性脊柱炎早期首发症状）。查体：右膝肿胀压痛，浮髌征阳性（提示膝关节积液），左侧4字征阳性（提示骶髂关节病变），左侧骶髂关节压痛（提示病变累及骶髂关节），左侧足跟肿胀压痛（提示附着点炎）。强直性脊柱炎病变一般为非对称性。综合该患者的病史及非对称性查体结果，诊断需考虑强直性脊柱炎，对诊断最有价值的检查是骶髂关节X线片。若发现骶髂关节骨质破坏、关节间隙变窄甚至骶髂关节融合对诊断有较大价值。强直性脊柱炎HLA-B27阳性率高达88%～96%，HLA-B27（E错）阳性对诊断起一定辅助作用，但不如骶髂关节X线片有价值。类风湿因子（A错）、抗CCP抗体（C错）主要用于诊断类风湿关节炎。强制性脊柱炎累及下肢大关节时一般不伴发骨关节破坏，作右膝关节X片（D错）一般无阳性发现。